酸性条件下基本不释放的制剂类型是
A. 泡腾颗粒
B. 可溶颗粒
C. 混悬颗粒
D. 缓释颗粒
E. 肠溶颗粒

正确答案：E。肠溶颗粒

解析：本题考查颗粒剂。肠溶颗粒（E对）酸性条件下基本不释放；肠溶颗粒是指用肠溶材料包裹颗粒制成的，耐胃酸；泡腾颗粒（A错）、可溶颗粒（B错）、混悬颗粒（C错）、缓释颗粒（D错）在酸性条件下可以释放。